可以降低口服药物生物利用度的因素是
A. 首过效应
B. 肝肠循环
C. 血脑屏障
D. 胎盘屏障
E. 血眼屏障

正确答案：A。首过效应

解析：本题考查首过效应。首过效应（A对）是指某些药物经胃肠道给药，在尚未吸收进入血循环之前，在肠黏膜和肝脏被代谢，而使进入血循环的原形药量减少的现象；肠肝循环（B错）指随胆汁排入十二指肠的药物或其代谢物，在肠道中重新被吸收，经门静脉返回肝脏，重新进入血液循环的现象；血脑屏障（C错）是血液与脑组织之间的屏障，只有脂溶性较高的药物才能透过血脑屏障进入脑组织；胎盘屏障（D错）是由胎盘绒毛与子宫血窦构成的，将母体与胎儿血液隔开的屏障；血眼屏障（E错）是血液与眼部的房水、晶状体和玻璃体等组织之间存在着的屏障。